阵发性室上性心动过速的发生机制主要是
A. 心肌缺血
B. 折返机制
C. 高血压病
D. 感染性心内膜炎
E. 洋地黄中毒

正确答案：B。折返机制

解析：阵发性室上性心动过速（PSVT）简称室上速。大部分室上速由折返机制（B对）引起，折返可发生在窦房结、房室结与心房，分别称为窦房折返性心动过速、房室结内折返性心动过速与心房折返性心动过速。具体可参考九版内科学P192-P193的心电生理检查。心肌缺血（A错）、高血压病（C错）、感染性心内膜炎（D错）和洋地黄中毒（E错）可伴有阵发性室上速，但均不是阵发性室上性心动过速的发生机制。